属于肽类激素但在药品零售企业可以经营的兴奋剂是
A. 胰岛素
B. 蛋白同化制剂
C. 利尿剂
D. 麻醉止痛剂

正确答案：A。胰岛素

解析：本题考查蛋白同化制剂、肽类激素的销售及使用管理。属于肽类激素但在药品零售企业可以经营的兴奋剂是胰岛素（A对）。兴奋剂分为七大类，包括：刺激剂、麻醉止痛剂（D错）、蛋白同化制剂、肽类激素及类似物、利尿剂（C错）、β受体阻滞剂、血液兴奋剂等。严禁药品零售企业销售胰岛素以外的蛋白同化制剂（B错）或其他肽类激素。药品零售企业必须凭处方销售胰岛素以及其他按规定可以销售的含兴奋剂药品。零售药店的执业药师应对购买含兴奋剂药品的患者或消费者提供用药指导。